下列关于肿瘤的治疗原则叙述中，恰当的是
A. 良性肿瘤可不予处理
B. 肿瘤细胞分化程度与治疗无直接关系
C. 手术适用于所有肿瘤的治疗
D. 肿瘤的生长部位对治疗有一定关系
E. 以上均正确

正确答案：D。肿瘤的生长部位对治疗有一定关系

解析：肿瘤的生长部位对治疗也有一定关系。如口咽部肿瘤：一般细胞分化程度较差，手术治疗又比较困难，手术后往往给患者带来严重功能障碍，故首先考虑能否应用放射治疗，必要时再考虑手术治疗。细胞分化程度较差或未分化的肿瘤对放射线较敏感，应采用放射与化学药物治疗，不是所有肿瘤都适合手术治疗。掌握“口腔颌面部肿瘤的治疗原则及预防”知识点。